对中性粒细胞有趋化作用的是
A. IL-1
B. IL-2
C. IL-8
D. IL-5
E. IL-6

正确答案：C。IL-8